一项病例对照研究，探讨妊娠期母亲的各种暴露史与新生儿先天性畸形之间的联系。在调查时，那些生畸形孩子的母亲由于心理压力常常隐瞒怀孕时的吸烟情况，而那些对照组儿童的母亲，其报告就较准确。上述情况可能带来
A. 选择偏倚
B. 存活病例偏倚
C. 信息偏倚
D. 混杂偏倚
E. 入院率偏倚

正确答案：C。信息偏倚